一患者不慎摔伤面部，临床检查及X线片提示下颌骨体部骨折,患者的治疗以下哪一项最合理
A. 复位牙及牙槽骨
B. 单颌固定
C. 仅缝合软组织
D. 坚固内固定
E. 不做处理

正确答案：D。坚固内固定

解析：本题考查颌骨骨折的固定方法。一患者不慎摔伤面部，临床检查及X线片提示下颌骨体部骨折,患者的治疗最合理的是坚固内固定（D对）。颌骨骨折的固定方法，目前以手术开放复位坚强内固定为治疗的主流技术。单颌固定（B错）是指在发生骨折的颌骨上进行固定，而不将上、下颌骨同时固定在一起的方法；可以非手术固定，也可以手术固定；主要用于线形并且移位不大的骨折。但单纯使用时固定力不足，目前多作为内固定的辅助方法。